诊断颅部的线形骨折主要靠
A. CTA
B. MRI
C. X线摄片
D. B超
E. 脑血管造影

正确答案：C。X线摄片

解析：颅部线性骨折的诊断主要依靠X线摄片（C对）或CT骨窗相，仅靠触诊很难发现。CTA（A错）即CT血管造影术，可用于头颈和颅内血管性疾病的筛查，对颅骨骨折无诊断价值。MRI（B错）对颅内软组织的显像效果较好，主要用于颅内肿瘤的诊断，而对骨皮质的显像效果较差，一般不用于颅骨骨折。B超（D错）对骨质的显像效果差，一般不用。脑血管造影（E错）主要用于颅内动脉瘤、脑血管疾病的诊断，对颅骨骨折的诊断价值不大。